在比较不同地区发病率或死亡率时应注意使用
A. 年龄别发病率、年龄别死亡率
B. 性别发病率、性别死亡率
C. 民族别发病率民族别死亡率
D. 标化发病率、标化死亡率

正确答案：D。标化发病率、标化死亡率

解析：本题考查标化比的应用。在进行不同地区的发病率和死亡率比较时，不能简单的直接进行发病率或死亡率的比较，需根据当地人口特点将发病率或死亡率进行标准化，标化后的发病率或死亡率称为标化发病率或标化死亡率（D对ABC错）。